某男，68岁。因心衰服用地高辛，不宜同时服用的成药
A. 麝香保心丸
B. 稳心颗粒
C. 通心络胶囊
D. 速效救心丸
E. 参松养心胶囊

正确答案：A。麝香保心丸

解析：本题考查的是老年人合理应用中药的原则。某男，68岁。因心衰服用地高辛，不宜同时服用的成药麝香保心丸（A对）。老年人合理应用中药的原则：1.辨证论治，严格掌握适应证：老年人体虚多病，病情往往复杂多变，若药物使用不当可使病情急转直下，甚至无法挽救，故首先应明确是否需要进行药物治疗。对有些病证可以不用药物治疗的就不用，更不要滥用。2.熟悉药品，恰当选择应用：由于老年人的靶器官或细胞的敏感性增强，使他们对药物的反应比年轻人强烈，特别是对中枢神经抑制药物、降血糖药物、心血管系统药物反应特别敏感，在正常剂量下的不良反应增加，甚至出现药源性疾病，因此在联合用药中应高度重视。如麝香保心丸与地高辛等强心类药物联合用药，由于麝香保心丸中所含蟾酥的基本化学结构与强心苷相似，在化学结构上有相似之处，故具有与强心苷类药物地高辛相似的强心作用，联合应用势必会造成相同或相似功效的累加，产生拟似效应，诱发强心苷中毒，出现频发性早搏等心律失常等不良反应。常有一些患有胃病的老年患者将银杏叶及其提取物制剂和法莫替丁片同时服用。法莫替丁片为抗溃疡抗酸药，与含有多量黄酮类成分的银杏叶制剂同时服用可产生络合效应，形成螯合物，影响疗效。因此，在服用抗酸类西药时应避免与含黄酮类的中药如复方丹参片、复方丹参滴丸、银杏叶片等同服，应分时应用，一般来讲，以间隔1小时为宜。患有糖尿病的心脑血管患者用培元通脑胶囊、益心通脉颗粒、活血通脉片等含有甘草、人参、鹿茸等成分的中成药，可使降糖药的疗效降低。因为，甘草、人参、鹿茸具有糖皮质激素样作用，可以促进糖原异生，升高血糖，与降糖药二甲双胍、消渴丸、阿卡波糖和胰岛素产生拮抗作用，导致降糖效果降低。因此，要尽量准确了解老年患者的用药情况，对此类患者尽量选用不含此类成分的中成药。如必须并用，应适当加大降糖药的剂量，并密切注意患者的血糖变化，避免加重患者的病情。此外，含有糖皮质激素样物质的中药甘草、鹿茸应避免与阿司匹林合用，防止加重对胃黏膜的损伤。3.选择合适的用药剂量：老年人肝肾功能多有不同程度的减退或合并多器官严重疾病。因此，用药要因人而异，一般应从“最小剂量”开始。尤其对体质较弱，病情较重的患者切不可随意加药。稳心颗粒（B错）：【注意事项】孕妇慎用。服药期间，忌食生冷食物，忌烟酒、浓茶。用药时应将药液充分搅匀，勿将杯底药粉丢弃。危重病人应采取综合治疗方法。通心络胶囊（C错）：【注意事项】方中全蝎、蜈蚣、土鳖虫有毒，水蛭有小毒，故孕妇忌用，不宜多服、久服。出血性疾患、妇女月经期及阴虚火旺型中风禁用。宜饭后服用。治疗期间，若心绞痛持续发作，应及时就诊救治。速效救心丸（D错）：【注意事项】孕妇禁用。气阴两虚、心肾阴虚之胸痹心痛者、有过敏史者及伴中重度心力衰竭的心肌缺血者慎用。服药期间，忌食生冷、辛辣、油腻食物，忌吸烟饮酒、喝浓茶。治疗期间，心绞痛持续发作宜加用硝酸酯类药。如果出现剧烈心绞痛、心肌梗死等，应及时救治。据报道，服用本品偶有引发口腔溃疡、口唇肿胀、急性荨麻疹及全身性皮疹的不良反应，使用时应注意。参松养心胶囊（E错）：【注意事项】孕妇慎用。应注意配合原发性疾病的治疗。服药期间，忌食生冷、辛辣、油腻食物，忌烟酒、浓茶。治疗期间，心绞痛持续发作者应及时就诊。